后牙游离缺失者一般采取模型向前倾斜，义齿就位方向应
A. 垂直就位
B. 水平就位
C. 从前向后
D. 从后向前
E. 以上说法均正确

正确答案：D。从后向前

解析：后牙游离缺失者一般采取模型向前倾斜，义齿由后向前斜向就位。掌握“局部义齿类型，肯氏分类及模型观测”知识点。